奥美拉唑+胶体果酸铋+克拉霉素，合并用药的目的是
A. 提高药物疗效
B. 减少不良反应
C. 治疗多种疾病
D. 延缓细菌耐药
E. 减少经济负担

正确答案：A。提高药物疗效

解析：本题考查药物的联合应用。奥美拉唑为质子泵抑制剂，胶体果酸铋为黏膜保护剂，克拉霉素为抗菌药，三药联合能够使药物疗效增加（A对）。